下列治疗痤疮的药物中，患者在治疗期间及治疗结束后1个月内应避免献血的是
A. 红霉素
B. 异维A酸
C. 克林霉素
D. 过氧苯甲酰
E. 米诺环素

正确答案：B。异维A酸

解析：本题考查痤疮治疗药。异维A酸（B对）具有致畸作用，治疗期间或治疗后1个月内应该避免献血。除此之外，治疗痤疮的非处方药有：过氧化苯甲酰凝胶、维A酸凝胶、克林霉素磷酸酯凝胶、红霉素-过氧化苯甲酰凝胶，处方药有：阿达帕林凝胶、米诺环素、口服维胺酯胶囊、葡萄糖酸锌等。过氧苯甲酰（D错）、红霉素-过氧化苯甲酰（A错）对皮肤有急性炎症及破损者禁用；对妊娠期妇女、儿童慎用。克林霉素（C错）对过敏者禁用；对幼儿不宜应用。米诺环素（E错）对肝、肾功能不全、食道通过障碍者、老年人、口服吸收不良或不能进食者及全身状态恶化患者（因易引发维生素K缺乏症）慎用。